穿心莲所含的穿心莲内酯具有抗菌、消炎作用，其所属的结构类型是
A. 有机酸类化合物
B. 香豆素类化合物
C. 二萜类化合物
D. 三萜类化合物
E. 倍半萜类化合物

正确答案：C。二萜类化合物

解析：本题考查穿心莲中的主要化学成分及其结构。穿心莲所含的穿心莲内酯具有抗菌、消炎作用，其所属的结构类型是二萜类化合物（C对）。穿心莲叶中含有多种二萜内酯及二萜内酯苷类成分，如穿心莲内酯、新穿心莲内酯、14-去氧穿心莲内酯、脱水穿心莲内酯等。酚酸类（A错）成分主要是丹参素、丹酚酸A、丹酚酸B、丹酚酸C、迷迭香酸、原儿茶酸、紫草酸单甲酯，其中丹酚酸B是丹参中酚性酸的主要成分。前胡主要化学成分为多种类型的香豆素（B错）及其糖苷、三萜糖苷及甾体糖苷、挥发油等。各种类型的香豆素化合物是前胡的主要代表成分和主要生理活性成分，其中白花前胡以角型二氢吡喃香豆素类为主，紫花前胡以线型二氢呋喃和二氢吡喃香豆素类为主。艾叶的化学成分主要有挥发油、黄酮和三萜类（D错）成分。单环倍半萜青蒿素（E错）是从中药青蒿（黄花蒿）中分离得到的具有过氧结构的倍半萜内酯，有很好的抗恶性疟疾活性，其多种衍生物制剂已用于临床。